男，56岁。突发性右侧肢体无力，伴头痛、呕吐，排黑便2次。有高血压和糖尿病史5年。黑便原因很可能是
A. 食管癌
B. 胃癌
C. 胃溃疡
D. 急性胃粘膜病变
E. 胃底静脉曲张破裂出血

正确答案：D。急性胃粘膜病变

解析：中老年男性患者，有高血压病史，突发性右侧肢体无力（偏瘫），伴头痛、呕吐（颅内压增高症状），提示患者颅内出血。严重的颅脑病变可致机体应激，引起急性胃黏膜病变（D对），导致出血、黑便。食管癌（A错）常表现为进行性吞咽困难；胃癌（B错）常表现为上腹痛、呕血、黑便，发热、乏力、体重下降等；胃溃疡（C错）常表现为周期性上腹痛；胃底静脉曲张破裂出血（E错）常见于门脉高压症，均不会出现偏瘫、头痛呕吐等中枢神经系统症状。